易入乳汁，并可抑制哺乳婴儿甲状腺功能的是
A. 甲睾酮
B. 甲巯咪唑
C. 甲苯磺丁脲
D. 甲硝唑
E. 甲基多巴

正确答案：B。甲巯咪唑

解析：本题考查哺乳期妇女禁用药。易入乳汁，并可抑制哺乳婴儿甲状腺功能的是甲巯咪唑（B对）。甲巯咪唑能透过胎盘并引起胎儿甲状腺功能减退及甲状腺肿大。乳母长期服用甲睾酮（A错）会导致女性胎儿男性化。甲苯磺丁脲（C错）可引起甲状腺功能亢进，使肝脏代谢药物的能力增强，因此甲状腺功能亢进者应慎用。甲硝唑（D错）属孕妇头三个月禁用药，三个月内服用可以引起胎儿畸形，另外其在母乳中的浓度与母血浓度相等，可引起婴儿呕吐和出血性恶液质。甲基多巴（E错）可排入乳汁，但未有对婴儿影响的报道，但哺乳妇女仍应慎用。